某患者，男，40岁，22、23缺失行固定烤瓷桥修复，应选择以下哪种治疗方案
A. 21、24做基牙
B. 11、21、24做基牙
C. 11、24、25做基牙
D. 11、21、24、25做基牙
E. 以上均可

正确答案：B。11、21、24做基牙

解析：本题考查固定桥的生理基础。21、24的牙周膜面积小于22、23，要增加基牙，因此选11、21、24做基牙（B对）。固定桥修复设计选择基牙时，应主要从支持与固位、共同就位道两方面进行考虑。对于本病例，选择3颗基牙即可达到修复效果，因此11、21、24、25做基牙（D错）不符合题干要求。